地震现场，一工人左腰及下肢被倒塌之砖墙压住，震后6小时救出，4小时后送抵医院。诉口渴，尿少，呈暗红色。检查：脉搏120次/min，血压95/70mmHg，左下肢明显肿胀，皮肤有散在淤血斑及水疱，足背动脉搏动较健侧弱，趾端凉，无骨折征。静脉输液宜首选
A. 全血
B. 血浆
C. 右旋糖酐
D. 等渗盐水加入1.25%碳酸氢钠溶液
E. 5%葡萄糖溶液

正确答案：D。等渗盐水加入1.25%碳酸氢钠溶液

解析：该患者左腰部及下肢（为肌肉丰富的部位）长时间受压，解除挤压后出现尿少，色暗红（提示为血红蛋白尿，考虑该患者有肾功能受损），下肢明显肿胀，足背动脉搏动减弱（提示血栓形成或肢体远端张力过高），应诊断为挤压伤综合征。另外，患者脉搏120次/分，血压95/70mmHg，休克指数（脉率/收缩压）为1.26，提示有休克可能（休克指数＞1.0～1.5提示有休克）。挤压伤综合征是指人体四肢或躯干等肌肉丰富的部位遭受重物（如石块、土方等）长时间的挤压，在挤压解除后出现的一系列病理生理改变。临床上主要表现为以肢体肿胀、肌红蛋白尿、高血钾为特点的急性肾功能衰竭。挤压伤综合征的治疗原则：①紧急处理：解除外力压迫，缩短受压时间；②妥善固定伤肢：立即用夹板或代用品固定伤肢于适当位置，以避免搬运过程中加重损伤。不宜抬高、按摩和热敷伤肢，以减少毒素的吸收；③抗休克：首选等渗盐水或平衡盐液扩容，改善循环；④碱化尿液：肌（血）红蛋白在碱性尿中溶解度大，可予5%碳酸氢钠100～200ml静滴，促使血红蛋白结晶溶解，防止肾小管堵塞。综合以上治疗措施，该患者在静脉输液时宜首选等渗盐水+1.25%碳酸氢钠溶液（D对）。挤压伤综合征由于红细胞大量破坏，细胞内的K⁺大量释放进入细胞外液，将导致高钾血症，若输入库存血如全血（A错）、血浆（B错），将导致血钾更高，故不宜应用。右旋糖酐（C错）是临床常用的多糖类血浆代用品，常用于低血容量休克、输血准备阶段替代血浆。5%葡萄糖溶液（E错）虽系等渗液，但进入体内后会迅速被氧化成二氧化碳和水，主要用于补充水和糖分，而不是为了扩容。